提取含有大量淀粉、黏液质中药中的水溶性有效成分的常用方法是
A. 水蒸气蒸馏法
B. 煎煮法
C. 浸渍法
D. 回流提取法
E. 连续回流提取法

正确答案：C。浸渍法

解析：本题考查的是浸渍法。提取含有大量淀粉、黏液质中药中的水溶性有效成分的常用方法是浸渍法（C对）。浸渍法：是在常温或温热（60℃～80℃）条件下用适当的溶剂浸渍药材以溶出其中有效成分的方法。本法适用于有效成分遇热不稳定的或含大量淀粉、树胶、果胶、黏液质的中药的提取。但本法出膏率低，需要特别注意的是当水为溶剂时，其提取液易于发霉变质，需注意加入适当的防腐剂。水蒸气蒸馏法（A错）：适用于具有挥发性的、能随水蒸气蒸馏而不被破坏，且难溶或不溶于水的化学成分的提取。此类化合物的沸点多在100℃以上，并在100℃左右有一定的蒸气压。煎煮法（B错）：是中药材加入水浸泡后加热煮沸，将有效成分提取出来的方法。此法简便，但含挥发性成分或有效成分遇热易分解的中药材不宜用此法。回流提取法（D错）：是用易挥发的有机溶剂加热回流提取中药成分的方法。但对热不稳定的成分不宜用此法，且溶剂消耗量大，操作麻烦。连续回流提取法（E错）：本法弥补了回流提取法中溶剂消耗量大，操作麻烦的不足，实验室常用索氏提取器来完成本法操作、但此法耗时较长。